龈下刮治术的目的是
A. 刮除牙周袋内根面上的牙石
B. 刮除牙周袋内根面上的菌斑
C. 刮除牙周袋内根面上的牙石和菌斑
D. 刮除牙周袋内根面上感染的病变牙骨质
E. 刮除牙周袋内根面上的牙石、菌斑和感染的病变牙骨质

正确答案：E。刮除牙周袋内根面上的牙石、菌斑和感染的病变牙骨质

解析：本题考查龈下刮治术的目的。龈下刮治术是用比较精细的龈下刮治器刮除位于牙周袋内根面上的牙石（A对）、菌斑（B对）。在做龈下刮治时，必须同时刮除牙根表面感染的病变牙骨质（D对），并使部分嵌入牙骨质内的牙石和毒素也能得以清除。（ABCD均对，故E为本题的正确答案）。